下列描述哪一类属于（牙合）干扰
A. 前伸（牙合）时，前牙有广泛接触
B. 侧方（牙合）时，非工作侧牙尖有接触
C. 前伸（牙合）时，前牙单点接触
D. 侧方（牙合）时，工作侧牙尖广泛接触
E. 深覆（牙合）

正确答案：B。侧方（牙合）时，非工作侧牙尖有接触

解析：本题考查（牙合）干扰。侧方（牙合）时，非工作侧牙尖有接触属于（牙合）干扰（B对），需磨改非工作侧早接触牙尖。前伸（牙合）时，前牙有多个牙接触，后牙牙尖有接触呈前伸（牙合）干扰（AC错）。侧方（牙合）时，工作侧牙尖广泛接触（D错），属于正常（牙合）。深覆（牙合）（E错）属于错（牙合）畸形，不属于（牙合）干扰。